气流受限可见于
A. 支气管扩张
B. 肺炎球菌肺炎
C. 肺结核
D. 慢阻肺
E. 双肺闻及哮鸣音

正确答案：D。慢阻肺

解析：慢性阻塞性肺疾病是一种具有气流受限特征的疾病，气流受限不完全可逆，呈进行性发展（D对）。支气管扩张是指继发于急、慢性呼吸道感染和支气管阻塞后，反复发生支气管炎症，导致支气管壁破坏，引起支气管异常和持久性扩张的疾病（A错）。肺炎球菌肺炎是最常见的肺炎，也是最常见的感染性疾病之一（B错）。结核病是由结核分枝杆菌引起的慢性感染性疾病（C错）。